造成药物临床前研究局限性的原因有
A. 人与动物试验具有种属的差异性
B. 滞后现象等难以在动物试验中观察
C. 研究时间长造成受干扰的因素增加
D. 人体的疾病因素可影响药物的反应
E. 研究中使用的实验动物数目有限

正确答案：A、B、D、E。人与动物试验具有种属的差异性；滞后现象等难以在动物试验中观察；人体的疾病因素可影响药物的反应；研究中使用的实验动物数目有限